大便时溏时泻，饮食减少，脘腹胀闷，水谷不化，稍进油腻之物，则大便次数增多，食少，面黄，肢倦乏力，舌淡苔白，脉细弱，治法应为
A. 温补脾胃
B. 益胃升阳
C. 健脾益胃
D. 健脾温中
E. 健脾益气

正确答案：E。健脾益气

解析：脾气亏虚，运化无权，水谷不化，清浊不分，故见大便时溏时泻；脾阳不振，运化失常故见饮食减少，脘腹胀闷，水谷不化，稍进油腻之物，则大便次数增多，食少；久泄不止，脾胃虚弱，气血来源不足，则见面黄，肢倦乏力；舌淡苔白，脉细弱，为泄泻脾气亏虚之象，治疗需健脾益气，化湿止泻（E对）。温补脾胃（A错）治疗脾胃阳虚证。益胃升阳（B错）治疗清阳不升证。健脾益胃（C错）治疗脾胃虚弱证。健脾温中（D错）治疗脾阳虚衰证。